下列各组药物中，不属于配伍禁忌的是
A. 川贝母与川乌
B. 藜芦与赤芍
C. 肉桂与赤石脂
D. 水银与砒霜
E. 硫黄与厚朴

正确答案：E。硫黄与厚朴

解析：该题考查的是中药的用药禁忌。十八反：本草明言十八反，半蒌贝蔹芨攻乌（A错），藻戟遂芫具战草，诸参辛芍叛藜芦（B错）。十九畏：硫黄原是火中精，朴硝一见便相争（E对）；水银莫与砒霜见（D错），狼毒最怕密陀僧；巴豆性烈最为上，偏与牵牛不顺情；丁香莫与郁金见，牙硝难合京三棱；川乌草乌不顺犀，人参最怕五灵脂；官桂善能调冷气，若逢石脂便相欺（C错）；大凡修合看顺逆，炮爁炙煿莫相依。